腮腺叙述错误的是
A. 向上到达颧弓，向下至下颌角
B. 向前至咬肌后1/3
C. 位于下颌支与胸锁乳突肌之间
D. 深面有茎突及茎突舌肌
E. 腮腺管越过咬肌浅面

正确答案：C。位于下颌支与胸锁乳突肌之间

解析：腮腺上达颧弓，下至下颌角(A对)，向前至咬肌后1/3浅面(B对)，其深部位于下颌支与胸锁乳突肌之间(C错，为本题正确答案)，腮腺深处有茎突及茎突舌肌(D对)，腮腺管横越咬肌浅面(E对)。